描述暴发疫情严重性的最佳指标是
A. 续发人数
B. 患病率
C. 发病人数
D. 罹患率
E. 患病人数

正确答案：D。罹患率

解析：罹患率常用于疾病暴发或流行时的调查，如传染病、食物中毒及职业中毒等暴发的调查（D对）。